女，38岁。上腹不适，纳差3年体重减轻，乏力半年，查体：贫血貌，上腹部轻压痛，Hb88g/L，MCV115fl，胃镜检查示胃体皱襞稀疏，黏膜血管透见。该患者应首先考虑的诊断是
A. Menetrier病
B. 慢性浅表性胃炎
C. 慢性萎缩性胃炎
D. 慢性淋巴细胞性胃炎
E. 胃癌

正确答案：C。慢性萎缩性胃炎

解析：中年女性患者，有上腹不适、纳差3年病史，胃镜检查示胃体皱襞稀疏，黏膜血管透见（慢性萎缩性胃炎的典型表现），诊断为慢性萎缩性胃炎（C对）。Menetrier病（P357）（A错）为慢性肥厚性胃炎，胃镜下可见胃体皱襞粗大、肥厚、扭曲呈脑回状，胃窦黏膜多正常。慢性浅表性胃炎（P354）（B错）为慢性非萎缩性胃炎，胃镜示黏膜呈红黄相间，或黏膜皱襞肿胀增粗。慢性淋巴细胞性胃炎（D错）是胃黏膜局限性或弥漫性淋巴细胞明显增生的良性疾病，临床上较为少见，病因尚不明确。胃癌（P365）（E错）胃镜下可见肿瘤表面常凹凸不平，糜烂，有污秽苔，活检时易出血。